某小学，6月一次中午进食火腿、汉堡包、粥、煮鸡蛋、炒空心菜、萝卜干，4小时后部分同学出现头痛、恶心、呕吐、食欲不振、腹泻、腹痛，个别有发热，体温38～40℃。引起食物中毒的可能病因是
A. 沙门菌
B. 副溶血性弧菌
C. 葡萄球菌肠毒素
D. 变形杆菌
E. 黄曲霉毒素

正确答案：A。沙门菌

解析：沙门菌（A对）引起的食物中毒潜伏期最短2小时，长者可达72小时，平均为12～24小时。主要有三种表现类型，即胃肠型、伤寒型、败血症型。以胃肠型最为常见。前驱症状有寒战、头痛、头晕、恶心与痉挛性腹痛，继之出现呕吐、腹泻、全身酸痛或发热。每天腹泻可达7～8次。体温在38～40℃之间。副溶血性孤菌（B错）中毒多集中在海产品，与本题中病史不符。葡萄球菌肠毒素（C错）中毒一般不发烧。变形杆菌（D错）中毒临床症状更剧烈，多有脐周围部的剧烈绞痛或刀割样疼痛。黄曲霉毒素（E错）中毒以肝脏病变为主，呈急性肝炎、出血性坏死、肝细胞脂肪变性和胆管增生。脾脏和胰脏也有轻度的病变。